生化丸为治疗产后病的常用药，其药物组成为
A. 当归
B. 川芎
C. 桃仁
D. 甘草
E. 干姜（炒炭）

正确答案：A、B、C、D、E。当归；川芎；桃仁；甘草；干姜（炒炭）

解析：本题考查的是生化丸药物组成。生化丸为治疗产后病的常用药，其药物组成为当归（A对）、川芎（B对）、桃仁（C对）、甘草（D对）、干姜（炒炭）（E对）。生化丸：【药物组成】当归、川芎、桃仁、干姜（炒炭）、甘草。